髁突软骨出现在
A. 胚胎第8周
B. 胚胎第9周
C. 胚胎第10周
D. 胚胎第11周
E. 胚胎第12周

正确答案：E。胚胎第12周

解析：下颌骨至出生的继续生长主要受3个继发性软骨（也称生长软骨）和肌附着发育的影响。髁突软骨出现在胚胎第12周，迅速形成一个锥形（或胡萝卜形）软骨团，占据发育中升支的大部分。该软骨团很快通过软骨内骨化转变为骨组织，至20周时，仅有薄层软骨覆盖在髁突头部。这部分软骨一直持续至20岁，维持下颌骨的生长。喙突软骨出现在发育的第4个月，位于喙突的前缘和顶端，是暂时的生长软骨，在出生前消失。中缝软骨有两块，出现在Meckel软骨两端之间的结缔组织中，在生后1年消失。不同数量的小的软骨岛也可作为发育中牙槽突的暂时结构。掌握“唾液腺与颌骨的发育”知识点。